每一次β-氧化的四个连续的酶促反应顺序正确的是
A. 脱氢→加水→硫解→再脱氢
B. 脱氢→再脱氢→加水→硫解
C. 脱氢→硫解→加水→再脱氢
D. 脱氢→硫解→缩水→再脱氢
E. 脱氢→加水→再脱氢→硫解

正确答案：E。脱氢→加水→再脱氢→硫解

解析：①脱氢：脂酰CoA在脂酰CoA脱氢酶催化下，在α和β碳原子上各脱去1个氢原子，生成α，β-烯脂酰CoA，脱下的氢由该酶的辅酶FAD接受生成FADH2。FADH2上的两个氢通过氧化呼吸链传递给氧生成水，同时伴有1.5分子ATP的生成。②加水：α，β-烯脂酰CoA在烯脂酰CoA水合酶催化下加水，生成L-β-羟脂酰CoA。③再脱氢：L-β-羟脂酰CoA在β-羟脂酰CoA脱氢酶催化下，脱去β碳上的2个氢原子，生成β-酮脂酰CoA。脱下的氢由该酶的辅酶NAD+接受，生成NADH+H+，后者经电子传递链氧化生成水及2.5分子ATP。④硫解：β-酮脂酰CoA在β-酮脂酰CoA硫解酶催化下，加1分子辅酶A使碳链断裂，生成1分子乙酰CoA和比原来少两个碳原子的脂酰CoA。掌握“脂肪的分解代谢”知识点。